某医师治湿阻中焦证，擅用厚朴，此药味苦、辛，温。其主要功效是
A. 燥湿，健脾
B. 燥湿，行气
C. 化湿，止呕
D. 化湿，解暑
E. 化湿，发表

正确答案：B。燥湿，行气

解析：本题考查的是厚朴的功效。厚朴味苦、辛，温。其主要功效是燥湿，行气（B对）。厚朴：【功效】燥湿，行气，消积，平喘。苍术：【功效】燥湿健脾（A错），祛风湿，发汗，明目。广藿香：【功效】化湿，止呕，发表解暑（CDE错）。